毒物在体内的代谢转化方式有
A. 还原、氧化、分解
B. 氧化、水解、结合
C. 还原、氧化、分解
D. 还原、氧化、水解、结合
E. 还原、氧化、分解、结合

正确答案：D。还原、氧化、水解、结合